女，58岁。咳嗽、痰中带血，左胸痛1个月。胸部X线片示左侧大量胸腔积液。查体：左侧呼吸音消失、语颤减弱。有助于明确诊断的检查不包括
A. 胸水细胞学及生化
B. 胸部CT
C. 胸膜活检
D. 支气管镜
E. 肺功能

正确答案：E。肺功能

解析：患者中老年女性，咳嗽、痰中带血，左胸痛1个月，胸部X线片示左侧大量胸腔积液，查体左侧呼吸音消失，语颤减弱，此时最主要的是明确胸水的性质。诊断性胸腔穿刺和胸水检查（A对）可确定胸水的性质，以明确病因。胸膜活检（C对）可发现肿瘤、结核和其他胸膜肉芽肿性病变。支气管镜（D对）对咯血或疑有气道阻塞者可行此项检查。CT（B对）或PET/CT检查可显示少量的胸腔积液、肺内病变、胸膜间皮瘤、胸内和胸膜转移性肿瘤、纵隔和气管旁淋巴结等病变。而肺功能（E错，为本题正确答案）主要用于COPD、哮喘的检查，鉴别阻塞性和限制性通气功能障碍，对胸水的性质及病因无帮助。